下课铃一响，几个校篮球队员便迫不及待地跑到操场上，分成两组，打起篮球。没打几分钟，周亮跳起投球，落地时摔倒了。好不容易站起来，右脚却不能动了，而且很痛。这种原因导致的运动性损伤可以采取的预防措施是
A. 安全防范法
B. 保护帮助法
C. 量力适应法
D. 准备活动法
E. 消除疲劳法

正确答案：D。准备活动法